解热镇痛抗炎药的作用机制是
A. 直接抑制中枢神经系统
B. 直接抑制PG的生物效应
C. 抑制PG的生物合成
D. 减少PG的分解代谢
E. 诚少缓激肽分解代谢

正确答案：C。抑制PG的生物合成